经阴道分娩时，为预防产后出血，静注麦角新碱应在
A. 胎头拨露阴唇后联合紧张时
B. 胎头已着冠时
C. 胎儿娩出时
D. 胎肩娩出时
E. 胎盘娩出时

正确答案：E。胎盘娩出时

解析：经阴道分娩时，为预防产后出血，应使用子宫收缩药物，麦角新碱是临床上除了缩宫素以外常用的子宫收缩药物，对子宫平滑肌有高度选择性，能够直接作用于子宫平滑肌，作用强而持久，效果和子宫的生理状态和用药剂量有关。妊娠子宫比未妊娠子宫敏感，成熟子宫比未成熟子宫敏感，对临产前的子宫或分娩后的子宫最为敏感。它与缩宫素作用的不同点主要是，不仅对子宫底而且对子宫颈部也有很强的收缩作用，剂量稍大即产生强直性收缩，一定要在胎盘娩出后使用（E对）。故不适用于催产和引产。用药时机要和缩宫素加以区别。